女，32岁。低热、盗汗、腹胀1个月，阵发性腹部绞痛，伴停止排气及排便10小时。目前该患首选的检査是
A. 超声检査
B. 消化道造影
C. 腹部CT
D. 结肠镜
E. PPD试验

正确答案：A。超声检査

解析：青年女性患者，低热、盗汗（结核中毒症状），阵发性腹部绞痛，伴停止排气、排便（提示肠梗阻），应考虑为结核性腹膜炎并肠梗阻。可以做超声、CT、磁共振可见增厚的腹膜、腹水、腹腔内包块及瘘管。超声检查操作简便易行，作为首选（A对）。